男，35岁。晚餐进食较多，餐后突然上腹刀割样疼痛迅速波及全腹，不敢直立行走，2h后急诊求治。查体：痛苦面容，腹式呼吸消失，腹膜刺激征（+），肝浊音界消失，肠鸣音消失。该患者最有可能的诊断是
A. 阑尾炎穿孔
B. 急性肠梗阻穿孔
C. 胃十二指肠溃疡穿孔
D. 胆囊穿孔
E. 急性胰腺炎

正确答案：C。胃十二指肠溃疡穿孔

解析：青年男性患者，餐后突发上腹刀割样疼痛并迅速波及全腹，查体见腹式呼吸消失，腹膜刺激征（+），肝浊音界消失，肠鸣音消失（提示腹腔空腔脏器穿孔），结合患者病史、体查，最可能的诊断为胃十二指肠溃疡穿孔（C对）。胃十二指肠溃疡穿孔后，消化液进入腹腔可刺激腹膜，引起上腹刀割样疼痛并迅速波及全腹，累及壁腹膜可出现腹膜刺激征；由于剧烈腹痛可使腹式呼吸减弱；穿孔后胃肠内气体进入腹腔，覆盖于肝脏表面可使肝浊音界消失。阑尾炎穿孔（A错）一般症状较轻且体征主要局限在右下腹，叩诊肝浊音界不消失。肠梗阻穿孔（B错）之前常有呕吐、腹痛、腹胀及停止自肛门排便排气、肠鸣音亢进等表现，穿孔后可有疼痛缓解的表现，这是由于气体进入腹腔造成暂时好转的假象，其腹膜炎的症状不如溃疡穿孔典型。胆囊穿孔（D错）的患者常有胆囊结石病史，主要表现为右上腹绞痛或持续性疼痛伴阵发性加剧，向右肩放射，Murphy征阳性，；急性胰腺炎（E错）疼痛一般位于左上腹并向背部放射，其发作不如溃疡穿孔急骤，肌紧张程度较轻，两者叩诊肝浊音界均不消失。